患者，女，20岁，未婚。近4个月月经提前8〜10天，量多、色淡、质稀，神疲肢倦，小腹空坠，舌淡，脉缓弱，诊为月经先期。其证候是
A. 气虚
B. 脾虚
C. 肾虚
D. 血虚
E. 阴虚

正确答案：A。气虚

解析：题中患者近4个月月经提前8〜10天，故诊断为月经先期。气虚统摄无权，故冲任不固，而致月经提前8〜10天且量多。气虚火衰，血失温煦，故经色淡、质稀。气虚则脏腑功能减退，故神疲肢倦，气虚无力升举，故小腹空坠，舌淡，脉缓弱为气虚之象（A对）。脾虚可有脾气虚与脾阳虚，脾气虚多见纳少、腹胀、便溏等脾运化失职之症，脾阳虚多四肢不温、畏寒怕冷等症状（B错）。肾虚多有腰膝酸软的症状，肾气虚者还有头晕耳鸣、夜尿频的症状，肾阳虚多有畏寒肢凉，小便清长，夜尿频多等症状，肾阴虚还有五心烦热，潮热盗汗等症状（C错）。血虚多伴面色淡白或萎黄，经量减少，经期延长等症状（D错）。阴虚多伴有口燥咽干，两颧潮红，五心烦热的症状，舌质红（E错）。